喉中间腔位于
A. 喉口与前庭裂之间
B. 喉口与声门裂平面之间
C. 前庭襞与声襞之间的向外突出处
D. 声门裂平面与环状软骨下缘之间
E. 前庭裂平面与声门裂平面之间

正确答案：E。前庭裂平面与声门裂平面之间

解析：喉中间腔位于前庭裂平面与声门裂平面之间（E对）。